顿咳常见于
A. 青年
B. 老年
C. 小儿
D. 女性
E. 男性

正确答案：C。小儿

解析：顿咳又称百日咳，常见于小儿（C对）。